屈肘和前臂旋前的肌是
A. 肱二头肌
B. 肱肌
C. 肱三头肌
D. 旋前圆肌
E. 旋后肌

正确答案：D。旋前圆肌

解析：肱二头肌（A错）屈肘关节，使前臂旋后，协助屈肩关节。肱肌（B错）屈肘关节。肱三头肌（C错）伸肘关节，伸和内收肩关节。旋前圆肌（D对）使前臂旋前，屈肘。旋后肌（E错）使前臂旋后。